单剂量包装的鼻用固体或半固体制剂应检查的是
A. 黏附力
B. 装量差异
C. 递送均一性
D. 微细粒子剂量
E. 沉降体积比

正确答案：B。装量差异

解析：本题考查装量差异检查。单剂量包装的鼻用固体或半固体制剂应做装量差异（B对）检查；黏附力（A错）是贴剂的检查项目；递送均一性（C错）是定量剂型及多剂量贮库型药剂检查项目；微细粒子剂量（D错）是气雾剂的检查项目；沉降体积比（E错）是混悬型滴鼻剂检查项目。